某患者，女，30岁，45、46缺失，且缺牙区两侧基牙情况良好，咬合关系正常，应选择以下哪种固定桥方案较合理
A. 44、47
B. 43、44
C. 47、48
D. 43、44、47、48
E. 43、44、47

正确答案：E。43、44、47

解析：44、47的牙周膜面积小于45、46，因此要增加基牙，所以选择43、44、47。掌握“固定桥的生理基础”知识点。